卡臂尖的作用是
A. 防止义齿龈向脱位
B. 防止义齿后向脱位
C. 防止义齿前向脱位
D. 防止义齿（牙合）向脱位
E. 防止义齿侧向脱位

正确答案：D。防止义齿（牙合）向脱位

解析：卡臂尖位于倒凹区，是卡环产生固位作用的部分，可防止义齿（牙合）向脱位。掌握“局部义齿固位体”知识点。